下列不属于细胞癌基因分类的是
A. src家族
B. ras家族
C. myc家族
D. sih家族
E. myb家族

正确答案：D。sih家族

解析：细胞癌基因根据功能来分类，可分为以下五个家族：src家族、ras家族、myc家族、sis家族和myb家族。掌握“癌基因与抑癌基因以及生长因子”知识点。